极低出生体重儿标准是指出生体重不足
A. 2 000g
B. 800g
C. 1 500g
D. 1 000g
E. 2 500g

正确答案：C。1 500g

解析：出生体重指出生后1小时内的体重，分为正常出生体重儿、低出生体重儿和巨大儿。正常出生体重儿是指BW≥2500g并≤4000g的新生儿。低出生体重儿是指BW＜2500g的新生儿，其中BW＜1500g称为极低出生体重儿（C对），BW＜1000g称为超低出生体重（ELBW）儿。巨大儿是指BW＞4000g的新生儿。